钙超载是指
A. 细胞外Ca2+的增多
B. 血浆内Ca2+增多
C. 细胞内Ca2+增多
D. 机体内Ca2+增多
E. 组织内Ca2+增多

正确答案：C。细胞内Ca2+增多

解析：由各种原因引起细胞Ca2+转运机制异常、细胞内Ca2+含量增多（C对），以致细胞结构损伤和功能代谢障碍为钙超载。